不属于饮酒导致口腔癌的途径的是
A. 乙醇的脱水作用使口腔黏膜对乙醇饮料中的致癌物质更敏感
B. 乙醇的即刻代谢产物乙醚可损害细胞
C. 酒精性肝病降低了肝脏对致癌物质的解毒作用
D. 乙醇可提高细胞对氧化剂的暴露和抑制免疫功能
E. 大量饮酒常影响人的食欲，人体对营养物质的摄取

正确答案：B。乙醇的即刻代谢产物乙醚可损害细胞

解析：饮酒导致口腔癌的途径有以下几种：①乙醇的脱水作用使口腔黏膜对乙醇饮料中的致癌物质更敏感；②乙醇的即刻代谢产物乙醛可损害细胞；③酒精性肝病降低了肝脏对致癌物质的解毒作用；④大量饮酒常影响人的食欲，从而影响人体对营养物质的摄取，加之酒精性肝脏的代谢能力受损，影响了营养物质的吸收，而营养缺乏显著降低了机体对癌症的抵抗力；⑤乙醇可提高细胞对氧化剂的暴露和抑制免疫功能等。掌握“口腔癌的预防”知识点。